最早提出并强调一定根据药物性质选择剂型的中医药著作为
A. 《新修本草》
B. 《本草经集注》
C. 《伤寒论》
D. 《神农本草经》
E. 《黄帝内经》

正确答案：D。《神农本草经》

解析：本题考查历代本草代表作。最早提出并强调一定根据药物性质选择剂型的中医药著作为《神农本草经》（D对）。《神农本草经》：简称《本经》，为汉代本草代表作。该书虽假托传说中的神农而作，但并非出于一时一人之手，而是经历了较长时间的补充和完善。原书已佚，现存各种版本均系后人考订、整理、辑复而成。其序例部分简要地总结了药物的四气五味、有毒无毒、配伍法度、服药方法、剂型选择等基本原则，初步奠定了中药学的理论基础。该书系统总结了汉代以前我国药学发展的成就，是现存最早的药学专著，为本草学的发展奠定了基础。《神农本草经》是我国本草学的奠基之作，与《黄帝内经》《黄帝八十一难经》《伤寒杂病论》（C错）一并被奉为“四大经典”。《新修本草》（A错）：又称《唐本草》，为隋唐时期唐代的本草代表作。该书是在普查全国药材基础上，由长孙无忌、李勣、苏敬等22人共同编撰而成。本书的完成依靠了国家的行政力量和充足的人力物力，是我国历史上第一部官修药典性本草，并被今人誉为世界上第一部药典，比公元1546年问世的欧洲纽伦堡药典《科德药方书》早887年。该书无论在内容和编写形式上都有新的突破，全面总结了唐以前的药物学成就，并很快流传于海内外，对后世医药学的发展影响极大。《本草经集注》（B错）：为魏晋南北朝本草代表作。作者为陶弘景。在序例部分除对《本经》条文逐一注释、发挥外，又补充了大量采收、鉴别、炮制、制剂、合药取量、诸病通用药及服药食忌等内容，大大丰富了药学理论。该书第一次全面系统地整理、补充了《本经》，反映了魏晋南北朝时期的本草学成就，初步确立了综合性本草著作的编写模式。《黄帝内经》（E错）的问世，奠定了中医学发展的理论基础，同时也对后世中药理论的发展和临床用药产生了巨大的影响。